小唾液腺发育
A. 较晚、约胎儿第11周，开口于皮肤黏膜
B. 较晚、约胎儿第12周，开口于口腔黏膜
C. 较早、约胎儿第2周，开口于口腔黏膜
D. 较早、约胎儿第3周，开口于皮肤黏膜
E. 胎儿第6周，开口于皮肤黏膜

正确答案：B。较晚、约胎儿第12周，开口于口腔黏膜

解析：小唾液腺发育较晚，约在胎儿第12周。上皮芽长入黏膜下层即分支并发育成腺体：导管较短，直接开口于口腔黏膜。掌握“唾液腺与颌骨的发育”知识点。